治头癣、虫积宜用
A. 橘皮
B. 沉香
C. 枳实
D. 薤白
E. 川楝子

正确答案：E。川楝子